手性药物的对映异构体之间的生物活性上有时存在很大差别，下列药物中，一个异构体具有麻醉作用，另一个对映异构体具有中枢兴奋作用的是
A. 苯巴比妥
B. 米安色林
C. 氯胺酮
D. 依托唑啉
E. 普鲁卡因

正确答案：C。氯胺酮

解析：本题考查药物的手性特征及其对药物作用的影响。氯胺酮（C对）有两个异构体，（+）-（S）-对映体具有麻醉作用，而（-）-（R）-对映体可产生中枢兴奋作用。利尿药依托唑啉（D错）对映体作用相反，左旋体具有利尿作用，右旋体则有抗利尿作用。米安色林（B错）对映体之间药理作用类型不同，（S）-对映体抗忧郁作用，（R）-对映体具有细胞毒性。苯巴比妥（A错）、普鲁卡因（E错）无对映异构体。